关于暴露时间的推算，下列哪项是不恰当的
A. 同源暴发暴露时间的推算，可从流行曲线的高峰处向前推一个常见潜伏期
B. 同源暴发暴露时间的推算，可以从流行曲线的高峰处向前推一个最短潜伏期
C. 同源暴发暴露时间的推算，可从流行曲线的高峰处向前推一个平均潜伏期
D. 同源暴发暴露时间的推算，可从第一例发病日期向前推一个最短潜伏期，从最后一个病例的发病日期向前推一个最长潜伏期，这两点之间的时间即为暴露时间

正确答案：B。同源暴发暴露时间的推算，可以从流行曲线的高峰处向前推一个最短潜伏期

解析：本题考查暴露时间的推算。暴露时间的估计可从首例病例发病日期向前推一个最短潜伏期，从病例高峰向前推一个平均潜伏期（B错，为本题正确答案），从末例病例向前推一个最长潜伏期。